下列因素中不是影响片剂成型因素的是
A. 药物的可压性
B. 药物的颜色
C. 药物的熔点
D. 水分
E. 压力

正确答案：B。药物的颜色